下列哪项不是癫证的治法
A. 疏肝理气
B. 化痰开窍
C. 涤痰泻火
D. 补养心脾
E. 养血安神

正确答案：C。涤痰泻火

解析：涤痰泻火为狂证痰火扰神的治法（C对）。癫证痰气郁结的治法：疏肝解郁，化痰醒神（A错）。癫证气虚痰结的治法：益气健脾，涤痰宣窍（B错）。癫证心脾两虚的治法：健脾养心，解郁安神（DE错）。